恶性高血压的病理特征是
A. 肾毛细血管纤维样坏死
B. 大、中动脉粥样硬化
C. 微血管炎
D. 肾脏纤维化
E. 肾细动脉纤维样坏死

正确答案：E。肾细动脉纤维样坏死

解析：恶性高血压的特征性病变是增生性小动脉硬化和坏死性细动脉炎，多累及于肾脏，主要表现为肾小动脉纤维样坏死，特征性的病变是增生性小动脉硬化 和坏死性细动脉炎。 前者主要表现为动脉内膜显著增厚，伴有 SMC 增生，胶原纤维增多，致血管壁呈层状洋葱皮样增厚，管腔狭窄 。 后者病变累及血管内膜和中膜，管壁发生纤维素样坏死（E对A错）。大、中动脉粥样硬化（B错）是动脉粥样硬化（AS）的病理特征。微血管炎（C错）可发生于全身各脏器，最常累及肾脏（如Ⅲ型急进型肾炎）。长期的高血压症状得不到控制时，可引起肾脏纤维化，但恶性高血压是急性过程，病程进展迅速，因此不会出现肾脏纤维化（D错）。